口腔扁平苔藓的病理特点是
A. 表面过度正角化
B. 基底膜清晰
C. 基底细胞角化
D. 固有层淋巴细胞细胞浸润带
E. 棘层异常增生

正确答案：D。固有层淋巴细胞细胞浸润带

解析：本题考查口腔扁平苔藓。口腔扁平苔藓的病理特点是固有层淋巴细胞细胞浸润带（D对）。口腔扁平苔藓（OLP）上皮固有层内有大量T淋巴细胞呈密集带状浸润是其典型病理表现之一。OLP缺乏特异性的病理表现，其主要组织学标准包括：出现界限清楚的淋巴细胞为主的带状炎细胞浸润，局限于结缔组织浅层；出现基底细胞液化变性；无上皮异常增生在。表面过度正角化（A错）；基底膜清晰（B错）；基底细胞角化（C错）；棘层异常增生（E错）均不是口腔扁平苔藓的病理特点。